以下哪项不是胎儿宫内窘迫的表现
A. 胎心120次/分
B. 胎心170次/分
C. 羊水呈绿色
D. 胎动5次/12小时
E. 胎儿电子监护出现晚期减速

正确答案：A。胎心120次/分